有关腘动脉的描述，正确的是
A. 在腘窝中位于胫神经外侧
B. 在收肌腱裂孔处续于股动脉
C. 腘静脉在其深面
D. 位于股二头肌止点腱外侧
E. 在腘窝上缘分为胫前动脉和胫后动脉

正确答案：B。在收肌腱裂孔处续于股动脉

解析：腘动脉在收肌腱裂孔处续于股动脉（B对），腘动脉在腘窝的深部下行，至腘肌的下缘分为胫前动脉和胫后动脉。